男，65岁。反复反酸、烧心、上腹胀4年，加重1个月。胃镜检查：食管下段见3条纵行黏膜破损，相互融合。目前最主要的治疗药物是
A. 硫糖铝
B. 西咪替丁
C. 铝碳酸镁
D. 奥美拉唑
E. 枸橼酸铋钾

正确答案：D。奥美拉唑

解析：老年男性患者，有反酸、烧心（胃食管反流病的典型症状）及上腹胀等临床表现，胃镜检查见食管下段黏膜多发纵形破损，相互融合（提示患者为反流性食管炎的C级或D级），诊断为重症反流性食管炎。奥美拉唑（D对）为质子泵抑制剂（PPI），适用于症状重、有严重食管炎的患者。西咪替丁（B错）为H₂受体阻滞剂（H₂RA），适用于轻、中症反流性食管炎患者。硫糖铝（A错）、铝碳酸镁（C错）为弱碱性抗酸药，仅用于症状轻、间歇发作的患者临时缓解症状。枸橼酸铋钾（E错）为胃黏膜保护剂（P362），是治疗消化性溃疡的二线药物。